绒毛膜促性腺激素来源于
A. 睾丸
B. 肾上腺皮质
C. 卵巢
D. 胎盘
E. 垂体

正确答案：D。胎盘